和病毒相关的主要炎症细胞
A. 巨噬细胞
B. 淋巴细胞
C. 中性粒细胞
D. 嗜酸粒细胞
E. 浆细胞

正确答案：B。淋巴细胞

解析：细胞免疫在抗病毒感染中起着重要作用，构成病毒适应性细胞免疫应答的主要效应因素是CD8⁺细胞毒性T细胞（CTL）和CD4⁺辅助性细胞（Th1），CTL（细胞毒性T淋巴细胞）能杀伤病毒感染的靶细胞，阻断病毒在细胞内复制，是终止病毒感染的主要免疫机制，活化的Th1细胞可释放多种细胞因子，通过激活巨噬细胞和NK细胞，诱发炎症反应，徐进CTL的增殖和分化等，在抗病毒感染中起重要作用，所以和病毒相关的主要炎症细胞是淋巴细胞（B对），在病毒感染时，体内淋巴细胞增高。巨噬细胞（A错）对阻止病毒感染和促使病毒感染的恢复能力具有重要作用（P228）。中性粒细胞（C错）虽也能吞噬病毒，但不能将其杀灭，病毒还能在其中增殖，引起扩散（P228）。中性粒细胞增多主要与急性感染特别是化脓性球菌感染有关，导致其增多的因素还有严重组织损伤、急性大出血、急性中毒和恶性肿瘤等。嗜酸性粒细胞（D错）是寄生虫感染相关的主要炎症细胞。浆细胞（效应B细胞）（E错）是由B淋巴细胞或记忆细胞受到抗原刺激后分化而成的一类分泌细胞，与机体的体液免疫相关，可清除血流中的病毒并有效防止再次感染（P228）。